男，29岁。排便时肛门剧痛1周，有鲜血滴入便池，排便后肛门疼痛加重。造成便后肛门疼痛加重的机制是
A. 截石位的12点处神经敏感
B. 肛门括约肌痉挛
C. 肛管皮肤全层裂开并形成慢性溃疡
D. 粪便干燥，排便用力过度
E. 继发肛窦炎

正确答案：B。肛门括约肌痉挛

解析：患者便时和便后疼痛，有出血，属于典型肛裂症状。肛裂患者便后肛门疼痛加重的机制是肛门括约肌痉挛（B对）。截石位的12点处神经并不比其他区域敏感（A错）。肛管皮肤全层裂开并形成慢性溃疡（C错）为肛裂原发病灶外观。粪便干燥，排便用力过度（D错）为肛裂形成原因之一。继发肛窦炎（E错）与肛周脓肿形成及继发肛瘘有关。